能作环转运动的关节有
A. 肘关节
B. 膝关节
C. 桡腕关节
D. 踝关节
E. 颞下颌关节

正确答案：C。桡腕关节

解析：桡腕关节（C对）属于椭圆关节，关节囊松弛，可以做屈、伸、展、收以及环转运动。肘关节属（A错）于复合关节，主要做前屈、后伸运动，也参与前臂的旋前和旋后运动。膝关节（B错）属于滑车关节，以屈伸运动为主，半屈膝时还可以做少量旋前旋后运动。踝关节（D错）属于滑车关节，可做背屈和跖屈运动。